属嘌呤类抗代谢物的药物是
A. 甲氨蝶呤
B. 巯嘌呤
C. 吉西他滨
D. 长春瑞滨
E. 卡莫氟

正确答案：B。巯嘌呤

解析：本题考查嘌呤拮抗剂类抗肿瘤药。巯嘌呤（B对）属于抑制嘌呤合成途径的细胞周期特异性抗代谢药。甲氨蝶呤（A错）为叶酸类抗代谢药。吉西他滨（C错）为二氟核苷类抗代谢药。长春瑞滨（D错）为长春碱类干扰有丝分裂的药物。卡莫氟（E错）为嘧啶类抗代谢药。